进行配比研究可减少
A. 选择偏倚
B. 信息偏倚
C. 混杂偏倚
D. 选择偏倚和混杂偏倚

正确答案：C。混杂偏倚

解析：本题考查进行配比研究可减少的偏倚。当我们研究某个因素与某种疾病的关联时，由于某个既与疾病有关系，又与所研究的暴露因素有联系的外来因素的影响，掩盖或夸大了所研究的暴露因素与疾病的联系，造成的偏倚叫混杂偏倚。在研究设计阶段可以对研究对象采取限制、配比等方法控制混杂偏倚（C对ABD错）。